容易发生心身疾病和精神疾病的高发年龄段是
A. 儿童期
B. 青年期
C. 中年期
D. 婴幼儿期
E. 老年期

正确答案：C。中年期

解析：中年是各种心身疾病和精神疾病的高发年龄段，但真正能就诊的比例仅是其一小部分。掌握“不同年龄阶段心理卫生”知识点。